下列心理测验的分类属于根据方法分类的是
A. 投射法
B. 个别测验
C. 智力测验
D. 人格测验
E. 神经心理学测验

正确答案：A。投射法

解析：心理测验的分类：根据测验方法分为问卷法、作业法、投射法；按测验的组织方法分为个别测验、团体测验；按测验的目的分为智力测验、人格测验、神经心理学测验。掌握“心理测验分类及其应用与一般原则”知识点。